乙脑的传播途径
A. 呼吸道
B. 消化道为主
C. 呼吸道和消化道
D. 皮肤粘膜接触
E. 蚊子媒介

正确答案：E。蚊子媒介

解析：本题考查乙脑的传播途径。乙脑主要通过蚊媒传播（E对ABCD错），有一定季节性。